男，68岁，咳嗽5年，近1年来自觉长距离行走时感气短，休息后可好转。否认呼吸系统疾病及心脏病史。查体未见明显异常。血常规及胸部X线片检查大致正常。为明确诊断应首先进行的检查是
A. UCG
B. D-二聚体
C. 动脉血气分析
D. 胸部CT
E. 肺功能

正确答案：A。UCG

解析：患者老年男性，5年，近1年来自觉长距离行走时感气短，休息后可好转，否认呼吸系统疾病及心脏病史，查体未见明显异常，血常规及胸部X线片检查大致正常，由于患者无呼吸系统疾病及心脏病史，考虑患者由于扩心病导致的左心功能降低，导致的心肺耐力减低，故为明确诊断，应首先进行的检查是超声心动图UCG（A对）检查明确左心室运动情况和左心排血量。D-二聚体（B错）检查多用于血栓性疾病，患者无心绞痛症状，故不考虑；动脉血气分析（C错）一般用于肺部疾病晚期呼吸衰竭的患者；胸部CT（D错）检查多用于肺癌检查，肺癌患者一般无气短等症状；肺功能（E错）检查一般用于确诊慢性阻塞性肺疾病。